急性毒性研究的接触时间是
A. 一次
B. 一次或8小时内多次
C. 一次或24小时内多次
D. 一次或14天内多次

正确答案：C。一次或24小时内多次

解析：本题考查急性毒性研究的接触时间。急性毒性指实验动物一次接触或24小时内多次接触一定剂量的某种外源化学物短期内所产生的健康损害作用和致死效应。可知急性毒性研究的接触时间是一次或24小时内多次（C对ABD错）。